关于土壤的组成不正确的是
A. 土壤是由固相、液相和气相物质组成
B. 土壤固相包括土壤矿物质和土壤有机质
C. 土壤矿物质约占土壤固体总重量的80%
D. 土壤液相是指土壤中水分及其水溶物
E. 土壤的气相是指土壤孔隙所存在的多种气体的混合物

正确答案：C。土壤矿物质约占土壤固体总重量的80%

解析：本题考查土壤的组成。土壤是陆地表面由矿物质、有机质、水、空气和生物组成，具有肥力，能生长植物的未固结层。土壤是由固相、液相和气相组成的三相多孔体系（A对）。土壤固相由土壤中矿物质、有机物质（B对）以及生活在土壤中的微生物和动物组成，土壤矿物质约占土壤固体总重量的90%以上（C错，为本题正确答案），土壤有机质约占固体总重量的1%～10%。土壤液相是指土壤中水分及其水溶物（D对）。土壤气相是指土壤孔隙所存在的多种气体的混合物（E对）。